对儿童进行乙型肝炎疫苗接种的实验研究，为评价其流行病学预防效果，应选用的指标是
A. 发病率
B. 死亡率
C. 效果指数
D. 病死率
E. 感染率

正确答案：C。效果指数